与病理缩复环关系最相关的是
A. 双胎妊娠
B. 重度先兆子痫
C. 胎盘早剥
D. 前置胎盘
E. 嵌顿性肩先露

正确答案：E。嵌顿性肩先露

解析：嵌顿性肩先露时，随子宫收缩的加强，子宫上段越来越厚，子宫下段被动扩张越来越薄，由于子宫上下段肌壁厚薄相差悬殊，形成环状凹陷，并随宫缩逐渐升高，甚至可高达脐以上，形成病理性缩复环（E对）。